住宅的卫生规模是指根据下列哪项提出的住宅居室容积、净高、面积和进深等应有的规模
A. 小气候要求
B. 卫生要求
C. 建筑要求
D. 环境保护要求
E. 房间的配置要求

正确答案：B。卫生要求

解析：本题考查住宅的卫生规模的提出依据。住宅的卫生规模是指根据卫生要求（B对ACDE错）提出的住宅居室容积、净高、面积和进深等应有的规模。